按照《医疗用毒性药品管理办法》，凡加工炮制毒性中药，必须按照
A. 《中华人民共和国药典》
B. 《中药志》
C. 《植物志》
D. 《中药大辞典》
E. 省、自治区、直辖市药品监督管理部门制定的《炮制规范》

正确答案：A、E。《中华人民共和国药典》；省、自治区、直辖市药品监督管理部门制定的《炮制规范》

解析：本题考查加工炮制毒性中药。按照《医疗用毒性药品管理办法》，凡加工炮制毒性中药，必须按照《中华人民共和国药典》（A对）或者省、自治区、直辖市卫生行政部门制定的《炮制规范》（E对）的规定进行。药材符合药用要求的，方可供应、配方和用于中成药生产。